升支与第二磨牙远中面间的间隙小，不能容纳阻生第三磨牙牙冠的近远中径属于
A. 正中位
B. 第Ⅱ类阻生
C. 垂直阻生
D. 低位阻生
E. 高位阻生

正确答案：B。第Ⅱ类阻生

解析：本题考查阻生牙的分类。升支与第二磨牙远中面间的间隙小，不能容纳阻生第三磨牙牙冠的近远中径属于第Ⅱ类阻生（B对）。根据牙与下颌升支及第二磨牙的关系可分为三类：I类：下颌升支和第二磨牙远中面之间，有足够的间隙可以容纳阻生第三磨牙牙冠的近远中径。II类：升支与第二磨牙远中面间的间隙小，不能容纳阻生第三磨牙牙冠的近远中径。III类：阻生第三磨牙的全部或大部位于下颌升支内。分类越高，牙齿的拔除难度越大。正中位（A错）是根据牙在正常牙列中线的位置进行分类的。垂直阻生（C错）是根据阻生第三磨牙的长轴与第二磨牙的长轴关系分类的。低位阻生（D错）和高位阻生（E错）是根据阻生牙与（牙合）平面的关系分类的。